孕妇使用可致婴儿视网膜病变
A. 甲巯咪唑
B. 硫酸镁
C. 氯丙嗪
D. 氯喹
E. 氯化钾

正确答案：C。氯丙嗪

解析：本题考查妊娠期妇女用药。妊娠期妇女长期应用氯丙嗪（C对）可致婴儿视网膜病变。